下列说法错误的是
A. 循证医学实践得到的最佳证据在用于具体患者的时候具有特殊性，必须因人而异
B. 循证医学实践将为临床决策提供依据，因此唯一强调的是证据
C. 循证医学不等于meta分析
D. 循证医学实践不一定会降低医疗费用
E. 循证医学实践得到的证据并非一成不变

正确答案：B。循证医学实践将为临床决策提供依据，因此唯一强调的是证据